某男，45岁。平日喜食辛辣，近日突发口舌生疮、咽喉疼痛、心胸烦热、小便短赤、大便秘结。证属火热内盛，治当清热泻火、利尿通便。宜选用的成药是
A. 芩连片
B. 西黄丸
C. 导赤丸
D. 清开灵片
E. 牛黄至宝丸

正确答案：C。导赤丸

解析：本题考查的是导赤丸的功能与主治。平日喜食辛辣，近日突发口舌生疮、咽喉疼痛、心胸烦热、小便短赤、大便秘结。证属火热内盛，治当清热泻火、利尿通便。宜选用的成药是导赤丸（C对）。导赤丸：【功能】清热泻火，利尿通便。【主治】火热内盛所致的口舌生疮、咽喉疼痛、心胸烦热、小便短赤、大便秘结。芩连片（A错）：【功能】清热解毒，消肿止痛。【主治】脏腑蕴热，头痛目赤，口鼻生疮，热痢腹痛，湿热带下，疮疖肿痛。西黄丸（B错）：【功能】清热解毒，消肿散结。【主治】热毒壅结所致的痈疽疔毒、瘰疬、流注、癌肿。清开灵片（D错）：【功能】清热解毒，镇静安神。【主治】外感风热时毒、火毒内盛所致高热不退、烦躁不安、咽喉肿痛、舌质红绛、苔黄、脉数；上呼吸道感染、病毒性感冒、急性化脓性扁桃体炎、急性咽炎、急性气管炎、高热等病症属上述证候者。牛黄至宝丸（E错）：【功能】清热解毒，泻火通便。【主治】胃肠积热所致的头痛眩晕、目赤耳鸣、口燥咽干、大便燥结。